典型心绞痛胸部疼痛的部位是
A. 心尖部
B. 左肩背部
C. 胸部左侧
D. 胸骨体上段或中段的后方
E. 胸部右侧

正确答案：D。胸骨体上段或中段的后方

解析：典型心绞痛胸部疼痛的部位是胸骨体上段或中段的后方（D对），可波及心前区，有手掌大小范围，甚至横贯前胸，界限不很清楚。常放射至左肩、左臂内侧达无名指和小指，或至颈、咽或下颌部。